如不用含磷酸的凝胶酸蚀，一般酸蚀后用水枪或注射器加压冲洗牙面
A. 5～10s
B. 10～15s
C. 15～20s
D. 20～30s
E. 35～40s

正确答案：B。10～15s

解析：酸蚀后用蒸馏水彻底冲洗，通常用水枪或注射器加压冲洗牙面10～15秒，边冲洗边用排唾器吸干，去除牙釉质表面的酸蚀剂和反应产物。如用含磷酸的凝胶酸蚀，冲洗时间应加倍。冲洗后立即交换干棉卷隔湿，随后用无油无水的压缩空气吹干牙面约15秒，也可采用挥发性强的溶剂如无水酒精、乙醚辅助干燥。掌握“窝沟封闭术”知识点。